某男，62岁。患痹证5年余，刻下关节冷痛、刺痛，且疼痛夜甚，屈伸不利，腰腿疼痛，四肢麻木。自行服用疏风定痛丸月余，出现头晕，头痛，舌体发硬，吞咽困难，心烦，无法入睡，口渴喜饮；今日见面部和颈部发僵，手足痉挛，医师诊断为药物中毒。根据其用药史和临床表现，分析此药物中毒为
A. 砷所致毒性反应
B. 汞所致毒性反应
C. 强心苷所致毒性反应
D. 乌头碱所致毒性反应
E. 番木鳖碱所致毒性反应

正确答案：E。番木鳖碱所致毒性反应

解析：本题考查马钱子及含马钱子的中成药含马钱子的中成药的中毒机制。其原因是番木鳖碱所致的惊厥痉挛（E对）。马钱子及含马钱子的中成药含马钱子的中成药包括九分散、山药丸、舒筋丸、疏风定痛丸、伤科七味片等。中毒机制：马钱子含番木鳖碱即士的宁，毒性大。成人服用5～10mg即可中毒，一次服用30mg即可致死。番木鳖碱首先兴奋中枢神经系统，引起脊髓强直性痉挛，继而兴奋呼吸中枢及血管运动中枢。雄黄及含雄黄的中成药，主要成分为砷盐。砷所致毒性反应（A错）：1.消化系统表现为口腔咽喉干痛、烧灼感，口中有金属味，流涎，剧烈恶心呕吐、腹痛腹泻，严重时类似霍乱。2.各种出血症状，如吐血、咯血、眼结膜充血、鼻衄、便血、尿血等。3.肝肾功能损害而引起转氨酶升高、黄疸、血尿、蛋白尿等。4.严重者因心力衰竭、呼吸衰竭而死亡。5.长期接触可引起皮肤过敏，出现丘疹、疱疹、痤疮样皮疹等。含朱砂、轻粉、红粉的中成药，此类药物中含有汞。汞所致毒性反应（B错）：1.消化系统表现为恶心呕吐、腹痛腹泻、口中有金属味、流涎、口腔黏膜充血、牙龈肿胀溃烂等。2.泌尿系统表现为少尿、蛋白尿，严重者可发生急性肾功能衰竭。3.神经系统及精神方面症状。蟾酥及含蟾酥的中成药，主要毒性成分为强心苷。强心苷所致毒性反应（C错）：1.循环系统表现为胸闷、心律失常、脉缓慢无力、心电图显示房室传导阻滞等。严重时面色苍白、口唇发绀、四肢厥冷、大汗虚脱、血压下降、休克，甚至心搏骤停而死亡。2.消化系统表现为恶心呕吐、腹痛、腹泻等。乌头类药物，主要成分为乌头碱。乌头碱所致毒性反应（D错）：1.神经系统表现为口舌、四肢及全身麻木，头痛，头晕，精神恍惚，语言不清或小便失禁，继而四肢抽搐、牙关紧闭、呼吸衰竭等。2.循环系统表现为心悸气短、心律失常、血压下降、面色苍白、口唇发绀、四肢厥冷等。3.消化系统表现为流涎、恶心、呕吐、腹痛、腹泻、肠鸣音亢进。